下列各项，不属麻黄汤功效的是
A. 解表
B. 发汗
C. 解肌
D. 平喘
E. 宣肺

正确答案：C。解肌

解析：麻黄汤具有发汗（B错）解表（A错），宣肺（E错）平喘（D错）的功效，可用于外感风寒表实证。本方的配伍特点有二：一为麻、桂相须，开腠畅营，则发汗解表之功益彰；二为麻、杏相使，宣降相因，则宣肺平喘之效甚著。